女，15岁。发现贫血黄疸5年。脾肋下2.5cm，质中。血红蛋白90g/L，网织红细胞比例0.05，白细胞和血小板均正常。红细胞渗透压渗透脆性试验：0.7%盐水溶液开始溶血。其父也有轻度黄疸。下列哪种贫血最有可能
A. 缺铁性贫血
B. 海洋性贫血
C. 遗传性球形细胞增多症
D. 遗传性铁粒幼细胞贫血
E. 巨幼细胞性贫血

正确答案：C。遗传性球形细胞增多症

解析：患者青少年女性，贫血、黄疸5年，慢性病程，查体：脾大，质中，考虑慢性血管外溶血；血常规：血红蛋白90g/L，提示贫血，网织红细胞比例0.05（正常值0.005～0.015），提示骨髓红系代偿性增生（符合溶血性贫血的变化），红细胞渗透脆性试验：0.7%盐水溶液开始溶血，即红细胞渗透脆性增加（遗传性球形细胞增多症的特征），其父也有轻度黄疸，提示阳性家族史，故患者贫血最可能的原因是遗传性球形细胞增多症（C对）。缺铁性贫血（P541）（A错）、遗传性铁粒幼细胞贫血（D错）、巨幼细胞性贫血（P544）（E错）可表现为贫血，但无黄疸、脾大、红细胞渗透脆性增加等表现；海洋性贫血（P555-P556）（B错）可有贫血、黄疸、肝脾大，但红细胞渗透脆性降低。